下列哪种情况下不能做口腔种植术
A. 活动义齿固位差，黏膜不能耐受，但患者患有严重的无法控制的糖尿病
B. 口腔内急性炎症已治愈者个别牙缺失，邻牙不宜作基牙
C. 颌骨内有肿瘤，经手术后需功能性修复者
D. 对义齿的修复要求高，常规义齿无法满足者
E. 磨牙游离端缺失者

正确答案：A。活动义齿固位差，黏膜不能耐受，但患者患有严重的无法控制的糖尿病

解析：本题考查口腔种植手术的适应证及禁忌证。患者是否适合种植手术，应根据全身及局部检查确定。全身情况差或因严重系统疾病不能承受手术者，如患有严重的无法控制的糖尿病（A错，为本题的正确答案），则不能做口腔种植术。口腔内急性炎症已治愈者个别牙缺失，邻牙不宜作基牙（B对）；颌骨内有肿瘤，经手术后需功能性修复者（C对）；对义齿的修复要求高，常规义齿无法满足者（D对）；磨牙游离端缺失者（E对）等，都是牙种植手术的常见适应证。